小儿自己想要做的事情要“我自己做”，常常不愿意成人帮忙。属于
A. 婴儿期
B. 学龄期
C. 第一反抗期
D. 第二反抗期
E. 智力关键期

正确答案：C。第一反抗期

解析：幼儿期思维出现了简单的逻辑思维和判断推理，模仿力极强，并出现了独立的愿望，开始自行其是，称为“第一反抗期”。掌握“不同年龄阶段心理卫生”知识点。